脓液恶臭，普通细菌培养阴性的是
A. 大肠杆菌
B. 拟杆菌
C. 绿脓杆菌
D. β-溶血性链球菌
E. 金黄色葡萄球菌

正确答案：B。拟杆菌

解析：脓液恶臭，普通细菌培养阴性一般提示该菌为专性厌氧菌。拟杆菌（B对）为专性厌氧菌，脓液恶臭，普通细菌培养阴性。大肠杆菌（A错）属兼性厌氧型，普通细菌培养阳性。绿脓杆菌（C错）为需氧菌，在普通培养基上易于生长，感染后脓液为绿色，有特殊的甜腥臭。β-溶血性链球菌（D错）为需氧或兼性厌氧菌，脓液为稀薄、血性，无臭味，普通培养基上生长不良（营养要求高，一般用血清或肉汤培养）。金黄色葡萄球菌（E错）脓液为黄绿色，无臭味，普通细菌培养阳性。